燀法炮制苦杏仁可防止苦杏仁苷发生
A. 加成反应
B. 消除反应
C. 甲基化反应
D. 乙酰化反应
E. 酶水解反应

正确答案：E。酶水解反应

解析：本题考查的是苦杏仁的炮制原理。燀法炮制苦杏仁可防止苦杏仁苷发生酶水解反应（E对）。在入汤剂煎煮过程中，开始有一段时间的温度适合苦杏仁的苦杏仁酶发挥作用，使苦杏仁苷迅速酶解放出氢氰酸而逸散。燀制品中的苦杏仁酶在燀制过程中因沸水煮烫破坏，故煎剂中苦杏仁苷的含量高于生品。所以苦杏仁炮制有利于保存药效，降低毒性，保证用药安全有效。